缺铁性贫血的检查结果为
A. MCV＞94fl，MCH＞32pg，MCHC＞38%
B. MCV＜80fl，MCH28～32pg，MCHC32%～38%
C. MCV80～94fl，MCH28～32pg，MCH32%～38%
D. MCV＜80fl，MCH＜28pg，MCHC＜32%
E. MCV＞94fl，MCH＞32pg，MCHC32%～38%

正确答案：D。MCV＜80fl，MCH＜28pg，MCHC＜32%

解析：根据红细胞平均体积（MCV）（正常值80～100fL）、红细胞平均血红蛋白含量（MCH）（正常值27～34pg）、红细胞平均血红蛋白浓度（MCHC）（正常值32%～36%）可将贫血分为小细胞低色素性贫血、正常细胞性贫血、大细胞性贫血，其对贫血的鉴别有一定的价值。缺铁性贫血呈小细胞低色素性贫血，MCV、MCH、MCHC均降低（D对）；MCV80～94fl，MCH28～32pg，MCHC32%～38%（C错）为正常细胞性贫血，常见于再障、急性失血性贫血等；MCV＞94fl，MCH＞32pg，MCHC32%～38（E错）为大细胞性贫血，常见于巨幼细胞性贫血。